引起人类赤霉病麦中毒的病原物质是
A. 黄曲霉毒素
B. T-2毒素
C. 岛青霉素
D. 丁烯酸内酯
E. 脱氧雪腐镰刀菌烯醇

正确答案：E。脱氧雪腐镰刀菌烯醇

解析：本题考查引起人类赤霉病麦中毒的病原物质。脱氧雪腐镰刀菌烯醇（E对ABCD错）是人类赤霉病麦中毒的主要病原物质，其毒作用主要是致呕吐。